错分偏倚
A. 由于回忆不准确引起的偏倚
B. 由于对病例的诊断错误所引起的偏倚
C. 两者均是
D. 两者均否

正确答案：C。两者均是

解析：本题考查错分偏倚的概念。错分偏倚又称信息偏倚，是指在获取暴露、结局或其他信息时所出现的系统误差或偏差，包括由于回忆不准确引起的偏倚和由于对病例的诊断错误所引起的偏倚（C对ABD错）。